关于心理评估的说法正确的是
A. 又叫心理测验
B. 是对个体的心理品质水平作出全面的鉴定
C. 是一种测量工具，但使用不当也会造成严重后果
D. 一般采用标准化数量化原则
E. 种类繁多应用广泛

正确答案：B。是对个体的心理品质水平作出全面的鉴定